入院病史中不属于既往史内容的是
A. 既往一般健康状况
B. 传染病史
C. 手术外伤史
D. 烟酒嗜好
E. 药物过敏史

正确答案：D。烟酒嗜好

解析：本题考查既往史的内容。入院病史中不属于既往史内容的是烟酒嗜好（D错，为本题正确答案）。烟酒嗜好属于个人史部分。既往史指患者过去的健康和疾病情况，内容包括既往一般健康状况（A对）、疾病史、传染病史（B对）、预防接种史、手术外伤史（C对）、输血史、食物或药物过敏史（E对）等。